根据《互联网药品交易服务审批暂行规定》，下列叙述错误的是
A. 互联网药品交易服务包括直接接触药品的包装材料和容器的互联网交易服务
B. 省级药品监管部门负责审批为药品生产、经营企业和医疗机构之间提供互联网药品交易服务的企业
C. 互联网药品交易服务机构资格证书由国家食品药品监督管理局统一印制，有效期五年
D. 向个人消费者提供互联网药品交易服务的企业，至少必须是药品连锁零售企业
E. 提供互联网药品交易服务的企业必须在其网站首页显著位置标明互联网药品交易服务机构资格证书号码

正确答案：A。互联网药品交易服务包括直接接触药品的包装材料和容器的互联网交易服务